在基底部有垂直于基底面的纵纹，可称为
A. 闰管
B. 发育管
C. 分泌管
D. 盲管
E. 以上都不正确

正确答案：C。分泌管

解析：本题考查唾液腺组织结构。分泌管与闰管相延续。管径较粗，管壁由单层柱状上皮所组成。核圆形，位于细胞中央或近基底部。胞质丰富，呈强嗜酸性。在基底部有垂直于基底面的纵纹，所以分泌管（C对）又称纹管。发育管、盲管是干扰说法。